女，45岁。被汽车撞伤4小时，出现右上腹及背部疼痛。向右肩部放射，呕吐物为血性。查体：T36.5℃，P100次／分，R18次／分。BP110/70mmHg，神志清楚。双肺呼吸音清，闻及干湿性啰音，心律齐，上腹部轻压痛，无明显肌紧张，直肠指检可在骶前触及捻发感，腹部平片见腹膜后积气。应首先考虑损伤的脏器为
A. 右肺部损伤
B. 肝脏损伤
C. 右肾损伤
D. 十二指肠损伤
E. 脾脏损伤

正确答案：D。十二指肠损伤

解析：患者中年女性，被汽车撞伤4小时后（外伤史），出现右上腹及背部疼痛（十二指肠损伤常见部位），向右肩部放射（十二指肠损伤常见放射部位）。呕吐物为血性（十二指肠损伤有时可有血性呕吐物）。直肠指检可在骶前触及捻发感（十二指肠损伤积气向盆腔扩散时的表现），腹部平片见腹膜后积气（十二指肠损伤X线常见表现），最有可能的诊断为十二指肠损伤（D对）。右肺损伤（A错）可出现咯血、胸痛、呼吸困难等表现，无明显腹痛。肝脏损伤（B错）（P321）X线可见右膈升高，肝正常轮廓消失。脾脏损伤（E错）（P321）X线可见胃右移，横结肠下移，胃大弯有锯齿形压迹。右肾损伤（C错）多出现血尿。另外，以上四种疾病均不会出现腹部平片积气及直肠指检捻发感现象。